吸收氮-（尿氮-尿内源氮）为
A. 摄入氮
B. 吸收氮
C. 储留氮
D. 粪代谢氮
E. 尿内源氮

正确答案：C。储留氮